患者，男，50岁。眩晕欲仆，头重脚轻，筋惕肉瞤，肢麻震颤，腰膝酸软，舌红苔薄白，脉弦细。其病机是
A. 肝阳上亢
B. 肝肾阴虚
C. 肝阳化风
D. 阴虚风动
E. 肝血不足

正确答案：C。肝阳化风

解析：本证以眩晕、肢麻震颤、头胀痛、面赤，甚至突然昏仆、口眼㖞斜、半身不遂等为辨证的依据。患者肝阳上亢，阴不制阳，阳亢化风，则眩晕欲仆；阳亢而气血上壅，上实下虚，则头重脚轻；风动筋脉挛急，阴亏筋脉失养，则筋惕肉瞤、肢体震颤；肝肾亏虚，则腰膝酸软；舌红，脉弦细为阳亢阴虚化风之征。故患者为肝阳化风证（C对）。肝阳上亢证指肝阳亢扰于上，肝肾阴亏于下，以眩晕耳鸣、头目胀痛、面红、烦躁、腰膝酸软等为主要表现的证候。而该患者出现筋惕肉瞤、肢体震颤等“动风”的症状与肝阳上亢证不符（A错）。肝肾阴虚证指肝肾阴液亏虚，虚热内扰，以腰酸胁痛、眩晕、耳鸣、遗精等为主要表现的虚热证候。患者没有出现虚热症状，而是出现筋惕肉瞤，肢麻震颤等“动风”的症状（B错）。阴虚风动证指肝阴亏虚，虚风内动，以眩晕，手足震颤、蠕动与阴虚症状为主要表现的证候。患者出现的是筋惕肉瞤，肢麻震颤的症状而非手足震颤、蠕动（D错）。肝血不足证指血液亏损，肝失濡养，以眩晕、视力减退、经少、肢麻震颤及血虚症状为主要表现的证候。患者未出现血虚症状（E错）。